表示聚氧乙烯类非离子表面活性剂溶解性与温度关系的是
A. HLB值
B. 置换价
C. kraff点
D. 昙点
E. 絮凝度

正确答案：D。昙点

解析：本题考查昙点的定义。聚氧乙烯型非离子表面活性剂，温度升高可导致聚氧乙烯链与水之间的氢键断裂，当温度上升到一定程度时，聚氧乙烯链可发生强烈脱水和收缩，使增溶空间减小，增溶能力下降，表面活性剂溶解度急剧下降并析出，溶液出现混浊，这一现象称为起昙，此温度称为浊点或昙点（D对）。